上颌骨是
A. 长骨
B. 短骨
C. 不规则骨
D. 扁骨
E. 均不是

正确答案：C。不规则骨

解析：有些不规则骨内有与外界相通的腔洞，称含气骨,如上颌骨,故上颌骨也属于不规则骨（C对）。